下列哪项不是佐剂应有的生物学作用
A. 可提高免疫原性
B. 可特异性的增强免疫功能
C. 提高抗体的滴度
D. 改变循环抗体的类型
E. 促进炎症的发生

正确答案：B。可特异性的增强免疫功能

解析：佐剂是非特异性免疫增强剂，所以可特异性的增强免疫功能是错误的。掌握“抗原基本概念、分类、超抗原及佐剂”知识点。